6个月男婴，体重7kg，身高69cm，皮肤红润，腹壁皮下脂肪0.8cm，肌张力正常
A. Ⅰ度营养不良
B. Ⅱ度营养不良
C. Ⅲ度营养不良
D. 恶性度营养不良
E. 正常儿

正确答案：E。正常儿

解析：本题考查正常儿的相关内容。6个月男婴平均体重为8.5kg，体重波动在6～11kg，均在正常范围之内，该男婴体重7kg，身高69cm，皮肤红润，腹壁皮下脂肪0.8cm，肌张力正常，则属于正常儿（E对ABCD错）。